患者，男，40岁。左肩部可见一肿块，呈扁平团块状，边界清楚，触之柔软，推之可动，无明显疼痛。应首先考虑的是
A. 血瘤
B. 失荣
C. 肾岩
D. 肉瘿
E. 肉瘤

正确答案：E。肉瘤

解析：血瘤边界不清（A错）。失荣发于颈部（B错）。肾岩发于阴茎（C错）。肉瘿发于颈前喉结一侧或双侧（D错）。肉瘤可发于全身各部位，好发于肩、背、腹、臀等位置，大小不一，边界清楚，皮色不变，触之柔软，呈扁平团块状，推之可移动，一般无疼痛，题中病例患者均符合这些特征，故考虑肉瘤（E对）。